解放初期，我国新疆察布查尔地区由于食用面酱的半成品（米送乎乎），使许多妇女和儿童发生中毒，其症状为：眼肌麻痹，视力模糊，眼睑下垂，继之咽部肌肉麻痹，吞咽困难，咀嚼无力，声音嘶哑，头下垂等，严重者出现呼吸困难，呼吸衰竭而死亡，但患者神志始终清楚，此类中毒可能为
A. 葡萄球菌肠毒素食物中毒
B. 肉毒中毒
C. 蜡样芽孢杆菌食物中毒
D. 副溶血性弧菌食物中毒
E. 变形杆菌食物中毒

正确答案：B。肉毒中毒